系统性红斑狼疮脏器损害最常见的是
A. 肝
B. 心
C. 脾
D. 肺
E. 肾

正确答案：E。肾

解析：系统性红斑狼疮（SLE）是一种侵犯全身结缔组织的自身免疫性疾病，病变累及多系统、多脏器。狼疮性肾炎（LN）是SLE最常见的内脏损害，在确诊为系统性红斑狼疮患者中，约70%有明显肾损害（E对），如作肾活检则几乎百分之百的患者有肾脏损害的病理改变，其肾脏病变的严重程度直接影响病人的预后，再早期多表现为无症状的尿异常，随着病程的发展，患者可出现大量蛋白尿、血尿、各种管型尿、氮质血症、水肿和高血压等，晚期发生尿毒症，是死亡的常见原因。不同系统性红斑狼疮患者的肝（A错）、心（B错）、脾（C错）、肺（D错）会有一定程度的损害，但这些均不是系统性红斑狼疮损害最常见的脏器。